梯形固位可用于
A. 邻（牙合）面洞
B. 邻（唇）颊面洞
C. 邻舌（腭）面洞
D. 后牙颊（牙合）面洞
E. 以上各种均包括

正确答案：E。以上各种均包括

解析：本题考查窝洞的固位形-梯形固位。邻（牙合）面洞（A对）在邻面做梯形，防止垂直向的脱位。邻（唇）颊面洞（B对）在邻面做梯形固位，防止充填物颊向的脱位。邻舌（腭）面洞（C对）在邻面做梯形固位，防止充填物舌向的脱位。后牙颊（牙合）面洞（D对）在颊面做梯形固位，防止义齿垂直向的脱位。（ABCD均对，故E为本题的正确答案）。